经筋的生理功能是
A. 主蓄积渗灌气血
B. 主联络机体内外
C. 主运行气血津液
D. 主束骨而利机关
E. 主经气的感应传导

正确答案：D。主束骨而利机关

解析：十二经筋，是十二经脉之气结、聚、散、络于筋肉、关节的体系，其分布与十二经脉在体表的循行基本一致。十二经筋多结聚于关节、骨骼附近，具有约束骨骼，主司关节运动的功能（D对）。